男，22岁。饥饿性上腹痛伴反酸1月余。2小时前呕血1次，暗红色，量约200ml。体重无明显变化。否认慢性肝病史。查体：贫血貌，腹软，上腹部有压痛，无反跳痛，肝脾肋下未触及。应首先考虑的出血原因是
A. 消化性溃疡
B. 急性糜烂性胃炎
C. 胃黏膜脱垂
D. 食管胃底静脉曲张破裂
E. 胃癌

正确答案：A。消化性溃疡

解析：青年男性患者，饥饿性上腹痛伴反酸1月余（提示十二指肠溃疡），2小时前呕血1次，否认慢性肝病史（可排除肝硬化引起的食管静脉曲张破裂出血），结合患者病史、体查，应考虑消化性溃疡大出血（A对）。急性糜烂性胃炎或应激性溃疡（P472）（B错）指在休克、复合性创伤、严重感染、严重烧伤等应激状态下发生的急性胃黏膜病变。胃黏膜脱垂（C错）指异常松弛的胃黏膜逆行突入食管或向前通过幽门管脱入十二指肠球部，主要表现为间歇性腹痛、上消化道出血、恶心、呕吐，出血量一般较少。食管胃底静脉曲张破裂（D错）多见于肝硬化等门脉高压的患者，病人多有慢性肝炎病史，临床上表现为呕吐大量鲜红色血液，易导致失血性休克。胃癌（E错）多见于中老年人，早期多无明显症状，晚期可有食欲下降、乏力、消瘦、体重减轻等表现。